接受躯体、四肢感觉的核为
A. 腹后外侧核
B. 腹后内侧核
C. 腹前核
D. 腹外侧核
E. 无

正确答案：A。腹后外侧核

解析：接受躯体、四肢感觉的核为腹后外侧核（A对）。腹后内侧核（B错）接受头面部感觉。腹前核（C错）、腹外侧核（D错）接受小脑齿状核、苍白球和黑质传入纤维，调节躯体运动。